男，70岁。因脑出血1小时入院，病情危重。医生建议立即手术，并告知家属手术可能存在的风险，同时告诉家属该患者预后可能不理想，家属考虑减少患者痛苦欲主动放弃治疗，听任其死亡，但拒绝对此签字。此时医生的应选择的最佳决策是
A. 一定要家属签字，否则让患者转院
B. 听从家属决定，并在病历上如实记录家属意见
C. 征求医院领导意见并与家属充分沟通，确定符合实际的救治手段
D. 提请法院作出决策
E. 不考虑家属意见，医生直接手术

正确答案：C。征求医院领导意见并与家属充分沟通，确定符合实际的救治手段

解析：医学伦理学的尊重原则是指在医疗实践中，医务人员对患者的人格尊严及其自主性的尊重。患者的自主性是指患者对与自己有关的医护问题，经过深思熟虑后，所做出的合乎理性的决定并据此采取行动，如知情同意、知情选择、要求保守秘密等。因此尊重原则要求医务人员尊重患者知情同意和选择的权利，对无行为能力的患者，应由其家属代理履行知情同意（DE错）。有利原则是指在医疗实践中，医务人员的诊治、护理行为对患者有益，既能减轻痛苦,又能促进康复。有利原则与尊重原则的冲突主要表现为医务人员合乎科学的选择与病人的自主决定相对立。当然，如果病人及其病人家属的决定会明显危害病人健康甚至会伤害其生命，则应积极采取措施有效化解其冲突（C对AB错）。